属于第三类溶剂的是
A. 乙醇
B. 甲醇
C. 聚乙二醇
D. 三氯甲烷
E. 四氯化碳

正确答案：A。乙醇

解析：本题考查溶剂分类。第三类溶剂是毒性低，对人体危害较小的溶剂。限度0.5%甲酸、乙酸、乙醇（A对）、丙醇、丁醇、乙醚、丙酮、DMSO、EA、正戊烷，正庚烷。